颞浅动脉起始段与颈外动脉成一直线，此型最多，约占
A. 0.52
B. 0.62
C. 0.72
D. 0.82
E. 0.92

正确答案：B。0.62

解析：颞浅动脉起始段走行方向与颈外动脉关系可分为二型。Ⅰ型：颞浅动脉起始段与颈外动脉成一直线，此型最多，约占62%。Ⅱ型：二者不成直线，而具有一定角度（110°～170°），约占38%。老年人的颞浅动脉迂曲较多，与颈外动脉之间也呈一定的角度，往往对逆行动脉插管造成困难。掌握“颈内外动脉主要分支及分布”知识点。